总体率（1－α）可信区间指按一定方法
A. 求得的区间包含总体率的可能性为（1－α）
B. 计算样本率抽样误差的大小
C. 求得总体率的波动范围
D. 估计样本率的大小
E. 估计样本含量

正确答案：A。求得的区间包含总体率的可能性为（1－α）